有关粉体性质的错误表述是
A. 休止角是粉体堆积成的自由斜面与水平面形成的最大角
B. 休止角越小，粉体的流动性越好
C. 松密度是粉体质量除以该粉体所占容器体积所求得的密度
D. 接触角θ越小，则粉体的润湿性越好
E. 气体透过法可以测得粒子内部的比表面积

正确答案：E。气体透过法可以测得粒子内部的比表面积